受体菌直接摄取供体菌游离的DNA片段，从而获得新的遗传性状的过程称为
A. 转化
B. 接合
C. 转导
D. 溶原性转换
E. 原生质体融合

正确答案：A。转化

解析：转化是指受体菌直接摄取供体菌游离的DNA片段，从而获得新的遗传性状。例如活的无毒力的肺炎链球菌可摄取死的有毒力的肺炎链球菌DNA片段，从而转化为活的有毒株。掌握“细菌遗传变异的物质基础及机制”知识点。